窝洞制备中，以下不属于抗力形设计的是
A. 去除无基釉
B. 去除薄壁弱尖
C. 邻（牙合）面洞制备阶梯
D. 邻（牙合）面洞制备梯形
E. 窝洞外形为圆缓曲线

正确答案：D。邻（牙合）面洞制备梯形

解析：本题考查窝洞的结构-抗力形和固位形。窝洞制备中，以下不属于抗力形设计的是邻（牙合）面洞制备梯形（D错，为本题的正确答案）。梯形固位属于固位形设计。窝洞的抗力形设计包括：去除无基釉（A对），无机釉缺乏牙本质支持，在承受力时易折断；去除薄壁弱尖（B对），薄壁弱尖是牙齿的脆弱部分，应酌情降低高度，减少（牙合）力负担；双面洞的（牙合）面洞底与邻面洞的轴壁应形成阶梯（C对），阶梯可分散（牙合）力，使（牙合）力由（牙合）面髓壁和邻面龈壁分担；窝洞外形线呈圆缓曲线（E对），圆缓的外形可分散应力。